肾髓质的组成是
A. 皮质深层的实质
B. 10余个肾锥体
C. 10余个肾锥体和肾柱
D. 弓形血管内侧的实质部分
E. 肾锥体、肾乳头、肾柱

正确答案：B。10余个肾锥体

解析：肾髓质由15~20个肾锥体构成（B对）。